发出分支分布于胰体
A. 胃左动脉.
B. 胃右动脉
C. 胃网膜左动脉
D. 胃网膜右动脉
E. 脾动脉

正确答案：E。脾动脉

解析：脾动脉（E对）在入脾门前发出分支胰支分布于胰体和胰尾。